男性，35岁。左颞部被木棒击伤后昏迷半小时清醒，3小时后又转入昏迷状态，头颅CT检查示左颞颅骨内侧双面凸透镜形密度增高影。下列哪项诊断可以成立
A. 左颞硬脑膜外血肿
B. 左颞硬脑膜下血肿
C. 左颞骨膜下血肿
D. 左颞帽状腱膜下血肿
E. 左颞蛛网膜下腔出血

正确答案：A。左颞硬脑膜外血肿

解析：青年男性患者，头部外伤，伤后昏迷半小时清醒，后又陷入昏迷状态（昏迷→清醒→昏迷，为硬膜外血肿的典型表现），头颅CT检查示左颞颅骨内侧双面凸透镜形密度增高影（硬膜外血肿的典型影像学表现）。结合患者病史、临床表现和影像学检查，左侧硬脑膜外血肿（A对）诊断可以成立。硬脑膜下血肿（P192）（B错）多表现为持续性昏迷或昏迷进行性加重，不会出现中间清醒期，典型的CT表现为脑表面新月形或半月形的高密度影。左颞骨膜下血肿（P185）（C错）属于头皮血肿，触诊可扪及头皮下波动感，一般不会出现意识障碍。帽状腱膜下血肿（P185）（D错）也属于头皮血肿，触诊可扪及头皮下明显的波动感。蛛网膜下腔出血（P208）（E错）主要见于颅内动脉瘤破裂、畸形脑血管破裂，以偏瘫、视力视野障碍为主要表现，极少见于颅脑外伤的患者。